据《素问·咳论》，五藏各以其时受病，“乘夏”则何脏先受邪
A. 肺
B. 肾
C. 心
D. 肝
E. 脾

正确答案：C。心

解析：乘秋则肺先受邪（A错），乘春则肝先受之（D错），乘夏则心先受之（C对），乘至阴则脾先受之（E错），乘冬则肾先受之（B错）。